表现为血肌酐检测值增高的疾病有
A. 急性肾小球肾炎
B. 肾移植术后排异
C. 肾病综合征
D. 类风湿关节炎
E. 胃十二指肠溃疡

正确答案：A、B。急性肾小球肾炎；肾移植术后排异

解析：本题考查血肌酐增高的疾病。表现为血肌酐检测值增高的疾病有急性肾小球肾炎（A对）、肾移植术后排异（B对）。血肌酐增高见于：（1）肾脏疾病：急慢性肾小球肾炎、肾硬化、多囊肾、肾移植后的排斥反应等，尤其是慢性肾炎者，Cr越高，预后越差。（2）其他：休克、心力衰竭、肢端肥大症、巨人症、失血、脱水、剧烈活动。肾病综合征（C错）是以肾小球基膜通透性增加，表现为大量蛋白尿、低蛋白血症的一组临床症候群。类风湿关节炎（D错）是一种自身免疫性疾病，表现为外周关节的炎症。胃十二指肠溃疡（E错）是消化系统常见的慢性病。